粒径≤100μm的大气颗粒物称为
A. TSP
B. 气溶胶
C. 细颗粒物
D. IP
E. 降尘

正确答案：A。TSP

解析：本题考查TSP。粒径≤100μm的大气颗粒物称为TSP（A对BCDE错），即总悬浮颗粒物，包括液体、固体或者液体和固体结合存在的，悬浮于空气中的颗粒。